导致心肌梗死毒性反应的丙戊酸钠的血浆浓度为
A. 1～2㎍/ml
B. 5～10㎍/ml
C. 10～20㎍/ml
D. 20～40㎍/ml
E. >200㎍/ml

正确答案：E。>200㎍/ml

解析：本题考查丙戊酸钠的致毒剂量。丙戊酸钠治疗的血浆浓度为5～150㎍/ml（ABCD错），血浆浓度>200㎍/ml（E对）时会出现导致心肌梗死毒性反应。